长期使用泼尼松的不良反应是
A. 血小板减少
B. 心力衰竭
C. 肾功能不全
D. 骨质疏松
E. 再生障碍性贫血

正确答案：D。骨质疏松

解析：本题考查泼尼松的不良反应。长期使用泼尼松的不良反应是骨质疏松（D对）。泼尼松为糖皮质激素类药物，长期大量应用可引起医源性肾上腺皮质功能亢进综合征，表现为肌无力与肌萎缩、皮肤变薄、向心性肥胖、满月脸、水牛背、痤疮、多毛、水肿、高血压、高脂血症、低钾血症、糖尿、骨质疏松等，停药后一般可自行恢复正常。糖皮质激素使红细胞和血红蛋白含量增加，大剂量可使血小板增多（A错）并提高纤维蛋白原浓度，缩短凝血时间。肾功能不全（C错）和再生障碍性贫血（E错）为糖皮质激素的适应证。